衡量某因素和某疾病间联系强度的最好指标是
A. 总人群中疾病的发生率
B. 暴露者中疾病的发生率
C. 因素的流行率
D. 相对危险度
E. 特异危险度

正确答案：D。相对危险度